女性，25岁。2小时前打扫室内清洁时突然出现咳嗽、胸闷、呼吸困难，追问病史近3年来每年秋季常有类似发作。体检：两肺满布哮鸣音，心脏无异常。X线胸片显示心肺无异常。该例诊断为
A. 慢性喘息性支气管炎
B. 慢性阻塞性肺疾病（A型）
C. 慢性阻塞性肺疾病（B型）
D. 支气管哮喘
E. 心源性哮喘

正确答案：D。支气管哮喘

解析：患者为青年女性，表现为季节性发作的咳嗽、胸闷、呼吸困难，有明显诱因，查体两肺满布哮鸣音，胸片示心肺无异常，考虑诊断为支气管哮喘（D对）。慢性喘息性支气管炎（A错）患者以喘息为突出症状，反复发作者胸片表现为肺纹理增粗、紊乱，急性发作期查体可闻及干、湿啰音。慢性阻塞性肺疾病（BC错）（慢性阻塞性肺疾病A型又称气肿型、红喘型；慢性阻塞性肺疾病B型又称支气管炎型、紫肿型。此分型八版内科学已删除）多见于中老年人，常有慢性咳嗽病史，喘息长年存在，查体有桶状胸等肺气肿体征，X线片可出现肺纹理增粗、紊乱和肺气肿的改变，两肺或可闻及湿啰音。心源性哮喘（E错）患者多有高血压、冠状动脉粥样硬化性心脏病、风湿性心脏病等病史和体征，表现为突发气急、端坐呼吸及阵发性咳嗽，常咳出粉红色泡沫痰，查体左心界扩大，胸部X线检查可见心脏增大、肺淤血征。